下列关于药品类易制毒化学品购销行为的说法，错误的是
A. 购买品类易制毒化学品原料药必须取得《购用证明》
B. 麻醉药品区域性批发企业之间不得购销小包装麻黄素
C. 药品类易制毒化学品只能使用现金或实物进行交易
D. 销售药品类易制毒化学品应当逐一建立购买档案

正确答案：C。药品类易制毒化学品只能使用现金或实物进行交易

解析：本题考查药品类易制毒化学品的管理。下列关于药品类易制毒化学品购销行为的说法，错误的是药品类易制毒化学品只能使用现金或实物进行交易（C错，为本题正确答案）。药品类易制毒化学品的购买许可：1.国家对药品类易制毒化学品实行购买许可制度。购买药品类易制毒化学品的，应当办理《药品类易制毒化学品购用证明》（以下简称《购用证明》）（A对），符合豁免办理《购用证明》情形（详见《药品类易制毒化学品管理办法》第21条）的除外。《购用证明》由国家药品监督管理部门统一印制，有效期为3个月。2.《购用证明》申请范围是受限制的，具有药品类易制毒化学品的生产、经营、使用相应资质的单位，方有申请《购用证明》的资格。3.申请《购用证明》的单位，向所在地省级药品监督管理部门或者省、自治区药品监督管理部门确定并公布的设区的市级药品监督管理部门提出申请，经审查，符合规定的，由省级药品监督管理部门发给《购用证明》。4.购买药品类易制毒化学品时必须使用《购用证明》原件，不得使用复印件、传真件。《购用证明》只能在有效期内一次使用。《购用证明》不得转借、转让。药品类易制毒化学品的购销管理：1.药品类易制毒化学品原料药的购销要求：（1）购买药品类易制毒化学品原料药的，必须取得《购用证明》。（2）药品类易制毒化学品生产企业应当将药品类易制毒化学品原料药销售给已取得《购用证明》的药品生产企业、药品经营企业和外贸出口企业。（3）药品类易制毒化学品经营企业应当将药品类易制毒化学品原料药销售给本省、自治区、直辖市行政区域内取得《购用证明》的单位。（4）药品类易制毒化学品经营企业之间不得购销药品类易制毒化学品原料药。2.教学科研单位购买药品类易制毒化学品的要求：教学科研单位只能凭《购用证明》从麻醉药品全国性批发企业、区域性批发企业和药品类易制毒化学品经营企业购买药品类易制毒化学品。3.药品类易制毒化学品单方制剂和小包装麻黄素的购销要求：（1）药品类易制毒化学品生产企业应当将药品类易制毒化学品单方制剂（如盐酸麻黄碱片、盐酸麻黄碱注射液、盐酸麻黄碱滴鼻液等）和小包装麻黄素销售给麻醉药品全国性批发企业。（2）麻醉药品全国性批发企业、区域性批发企业应当按照《麻醉药品和精神药品管理条例》第三章规定的渠道销售药品类易制毒化学品单方制剂和小包装麻黄素。（3）麻醉药品区域性批发企业之间不得购销药品类易制毒化学品单方制剂和小包装麻黄素（B对）。（4）麻醉药品区域性批发企业之间因医疗急需等特殊情况需要调剂药品类易制毒化学品单方制剂的，应当在调剂后2日内将调剂情况分别报所在地省级食品药品监督管理部门备案。4.药品类易制毒化学品禁止使用现金或者实物进行交易。5.药品类易制毒化学品生产企业、经营企业销售药品类易制毒化学品，应当逐一建立购买方档案（D对）。购买方为非医疗机构的，档案内容至少包括：（1）购买方《药品生产许可证》或《药品经营许可证》、企业营业执照等资质证明文件复印件。（2）购买方企业法定代表人、主管药品类易制毒化学品负责人、采购人员姓名及其联系方式。（3）法定代表人授权委托书原件及采购人员身份证明文件复印件。（4）《购用证明》或者麻醉药品调拨单原件。（5）销售记录及核查情况记录。购买方为医疗机构的，档案应当包括医疗机构麻醉药品、第一类精神药品购用印鉴卡复印件和销售记录。6.药品类易制毒化学品生产企业、经营企业销售药品类易制毒化学品时，应当核查采购人员身份证明和相关购买许可证明，经核查无误后方可销售，并保存核查记录。发货应当严格执行出库复核制度，认真核对实物与药品销售出库单是否相符，并确保将药品类易制毒化学品送达购买方《药品生产许可证》或者《药品经营许可证》所载明的地址，或者医疗机构的药库。在核查、发货、送货过程中发现可疑情况的，应当立即停止销售，并向所在地药品监督管理部门和公安机关报告。